发现结核病传染源的主要方法是
A. 痰结核菌检查
B. 胸部X线片
C. X线胸部透视
D. 临床症状
E. 痰培养

正确答案：A。痰结核菌检查